下列不属于空气中化学物的物理形态的是
A. 云
B. 雾
C. 烟
D. 尘

正确答案：A。云

解析：本题考查空气中化学物的物理形态。空气中的化学毒物以气态（气体、蒸汽）和气溶胶（烟（C对）、雾（B对）、粉尘（D对））等形式存在。云（A错，为本题正确答案）不属于空气中化学物的物理形态。